呕吐的病机是
A. 胃失和降，逆气动膈
B. 胃失和降，胃气上逆
C. 胃气阻滞，胃失和降
D. 脾胃虚寒，胃中无火
E. 痰瘀互结，食道狭窄

正确答案：B。胃失和降，胃气上逆

解析：胃失和降，逆气动膈为呃逆的病机（A错）。呕吐多因外感六淫、内伤饮食、情志不调、禀赋不足均可影响胃，使胃失和降，胃气上逆，发为呕吐（B对）。胃气阻滞，胃失和降为胃痛的病机（C错）。脾胃虚寒，胃中无火为反胃的病机（D错）。痰瘀互结，食道狭窄为噎膈的病机（E错）。